为确诊伤寒病程第一周阳性率最高的检测是
A. 血培养
B. 尿培养
C. 大便培养
D. 胆汁培养
E. 肥达反应

正确答案：A。血培养